休克时反映内脏器官灌注情况，简单方便的观察指标是
A. 精神状态
B. 皮肤温度，色泽
C. 血压
D. 趺阳脉搏动
E. 尿量

正确答案：A。精神状态

解析：休克时反映内脏器官灌注情况，简单方便的观察指标是精神状态临床上延续多年的休克诊断标准是：①有诱发休克的原因。②有意识障碍（A对）。③脉搏细速，超过100次/分钟或不能触知。④四肢湿冷，胸骨部位皮肤指压阳性（压迫后再充盈时间超过2秒钟），皮肤有花纹（B错），黏膜苍白或发绀，尿量少于30mL/h或尿闭（E错）。⑤收缩血压低于10.7kPa（80mmHg）（C错）。⑥脉压差小于2.7kPa（20mmHg）。⑦原有高血压者，收缩血压较原水平下降30%以上。凡符合上述第①项以及第。②、③、④项中的两项和第。⑤、⑥、⑦项中的一项者，可诊断为休克。趺阳脉搏动不在休克的诊断标准中（D错）。